下列哪项不属于感染性腹泻的防治措施
A. 切断传播途径
B. 建立防治门诊
C. 提倡使用药物预防
D. 开展疫情监测
E. 保护易感染群

正确答案：C。提倡使用药物预防